根据牙列缺损的Kennedy分类，4321|12缺失者属于
A. 第三类第二亚类
B. 第三类第一亚类
C. 第三类
D. 第四类第二亚类
E. 第四类

正确答案：E。第四类

解析：本题考查Kennedy牙列缺损分类。4321|12缺失是前牙连续缺失且跨越中线，天然牙在缺隙远中，属于第四类（E对）。第三类第二亚类（A错）指牙弓的一侧牙缺失，缺隙两端均有天然牙存在且还存在两个缺牙间隙。第三类第一亚（B错）类指牙弓的一侧牙缺失，缺隙两端均有天然牙存在且还存在一个缺牙间隙。第三类（C错）指牙弓的一侧牙缺失，缺隙两端均有天然牙存在且不存在其他缺牙间隙。第四类指牙弓前部牙连续缺失并跨过中线，天然牙在缺隙远中，为单缺隙，无亚类，因为要以最后的缺牙间隙决定分类，如果第四类还存在别的缺牙间隙，则就不属于第四类了，所以没有第四类第二亚类（D错）这种说法。